除另有规定外，应在2小时内全部溶散的是
A. 糊丸
B. 滴丸
C. 小蜜丸
D. 大蜜丸
E. 包衣滴丸

正确答案：A。糊丸

解析：本题考查的是丸剂的溶散时限检查。除另有规定外，应在2小时内全部溶散的是糊丸（A对）。丸剂的溶散时限：除另有规定外，小蜜丸（C错）、水蜜丸和水丸应在1小时内全部溶散；浓缩丸和糊丸应在2小时内全部溶散；滴丸（B错）应在30分钟内全部溶散，包衣滴丸（E错）应在1小时内全部溶散。蜡丸照崩解时限检查法片剂项下的肠溶衣片检查法检查，在盐酸溶液中（9→1000）检查2小时，不得有裂缝、崩解或软化现象，再在磷酸盐缓冲液（pH6.8）中检查，1小时内应全部崩解。除另有规定外，大蜜丸（D错）及研碎、嚼碎后或用开水、黄酒等分散后服用的丸剂不检查溶散时限。